位于延髓的后正中沟两侧
A. 小脑下脚
B. 橄榄
C. 薄、楔束结节
D. 锥体
E. 无

正确答案：C。薄、楔束结节

解析：位于延髓的后正中沟两侧各有两个膨大，分别为薄束结节、楔束结节（C对）。小脑下脚（A错）位于楔束结节外上方。锥体（D错）位于延髓的前正中裂两侧。橄榄（B错）位于锥体上部背外侧。